女，30岁。进行性痛经8年，婚后5年未孕。妇科检查：子宫大小正常，后位，固定，盆底可触及多个结节，右侧附件区触及直径约6厘米的囊性包块，不活动，左侧附件区组织略增厚。首先选取的治疗方案是
A. 孕激素治疗
B. 手术治疗
C. 抗炎治疗
D. 抗结核治疗
E. 镇痛治疗

正确答案：B。手术治疗

解析：该患者为育龄期女性，进行性痛经8年，婚后5年未孕（子宫内膜异位症好发于育龄期妇女，典型症状为继发性痛经、进行性加重）。妇检：子宫大小正常，盆底可触及多个结节，右侧附件区触及直径约6厘米的囊性包块，不活动，左侧附件区组织略增厚（典型盆腔内异症双合诊检查时，可发现子宫后倾固定，直肠子宫陷凹、宫骶韧带或子宫后壁下方可扪及触痛性结节，一侧或双侧附件处触及囊实性包块，活动度差），诊断为子宫内膜异位症。因右侧附件区囊性包块较大且有生育要求，首先选取的治疗方案是保留生育功能的手术治疗（B对）。孕激素治疗（P272）（A错）主要用于有慢性盆腔痛、经期痛经症状明显、有生育要求及无卵巢囊肿形成的内异症患者。抗炎治疗（B错）不用于子宫内膜异位症的治疗。抗结核治疗（D错）主要用于治疗结核。镇痛治疗（P272）（E错）仅适用于轻度内异症患者。